地面水中硫酸盐含量骤然增加时，表明其受
A. 生活污水污染
B. 农田径流污染
C. 工业废水污染
D. 人、畜粪便污染
E. 含氮有机物污染

正确答案：A、B、C。生活污水污染；农田径流污染；工业废水污染

解析：本题考查地面水的污染特点。天然水中均含有硫酸盐，其含量主要受地质条件的影响。地面水中硫酸盐含量骤然增加时，表明其受生活污水（A对）、工业废水（C对）或农田径流（B对DE错）等污染。